某干部生活习惯良好，性格急躁，易冲动，工作认真，争强好胜，雄心勃勃，一年前因小事上火入院，诊断为冠心病，此病人的人格类型是
A. A型
B. B型
C. C型
D. AB混合型
E. BC混合型

正确答案：A。A型

解析：A型人格表现为有较高的成就欲望，富于挑战和竞争精神，容易发生无端敌意，争强好胜，不耐烦，有时间紧迫感等，A型行为会增加患冠心病的风险。此题患者属典型A型人格类型（A对）。B型人格（B错）表现为特别有耐心的，谦虚的，放松的，有安全感的，有适当自尊的。C型人格第六版医学心理学未详细论述，查找资料得知，C型人格（C错）就是容易使人患癌症的心理行为模式，主要表现为过度压抑情绪，尤其是不良的情绪，如愤怒、悲伤等，不让它们得到合理的舒泄。